一年轻人在打羽毛球时自己的球拍把额头碰破了一块皮，到某医院就医。接诊医生查看后，问明患者属公费医疗，于是开出了CT检查单，查后结果为阴性。此类现象产生的根源是
A. 医生诊断水平不高
B. 医生对高新技术手段过度迷信
C. 市场经济对医学服务的负面影响
D. 生物医学模式对医生的负面影响
E. 医院管理不到位

正确答案：C。市场经济对医学服务的负面影响

解析：在市场经济条件下，个别单位、个别人员受市场经济消极因素的影响，把医患之间的这种诚信关系加以扭曲，看成单纯的商品供应者与消费者的经济关系或单纯的契约关系，片面追求自身的经济利益，导致医患之间关系紧张和不信任。然而，这也从另一个侧面揭示了医患关系的信托性质，说明忽视或背离信托性质的医患关系只能是一种矛盾的、不和谐的关系。掌握“医患关系伦理”知识点。